鼻腭神经阻滞麻醉将注射针自腭乳头侧缘刺入黏膜后，进入腭前孔的方向是
A. 向前上方
B. 向前下方
C. 向后上方
D. 向后下方
E. 垂直刺入

正确答案：C。向后上方

解析：本题考查颌面部常用局麻法及牙拔除的麻醉选择。鼻腭神经阻滞麻醉：患者头后仰，大张口，注射针自腭乳头侧缘刺入黏膜，然后将针摆向正中，使之与中切牙长轴平行，向后上方（C对）推进约0.5cm，可进入腭前孔。该处组织致密，注射麻药时需用较大压力，一般注入量为0.25～0.5ml。